国际食品数据系统网络（INFOODS）的成立机构是
A. 国际粮农组织和哈佛大学
B. 国际联合大学和哈佛大学
C. 世界卫生组织和国际粮农组织
D. 世界卫生组织和和哈佛大学
E. 国际粮农组织和国际联合大学

正确答案：E。国际粮农组织和国际联合大学

解析：本题考查国际食品数据系统网络（INFOODS）的成立机构。国际粮农组织（FAO）和联合国大学（UNU）（E对ABCD错）共同成立了国际食品数据系统网络（INFOODS），以食物成分研究科学为基础，制定了以食物分类、营养素定义、分析方法、数据描述和质量控制为主的工作方向。